根尖区急性炎症应急处理有
A. 开髓引流
B. 切开排脓
C. 急性期拔牙
D. 调（牙合）
E. 以上都对

正确答案：E。以上都对

解析：本题考查根尖区急性炎症的应急处理。开髓引流（A对）和切开排脓（B对）都是为了建立引流通道，减小压力，减轻疼痛。若炎症局限，患牙无保留价值，急性期拔牙（C对）有利于去除病灶和引流，达到切开排脓的效果，可在有效抗生素控制下拔除，但复杂性拔牙易引起炎症扩散，应先保守治疗后拔牙。由外伤引起的急性根尖周炎，通过调（牙合）（D对），牙髓及根尖周症状有可能消除。（ABCD均对，故E为本题的正确答案）。